下列各项，最符合“主诉”书写要求的是
A. 患高血压病3年
B. 心绞痛反复发作3年
C. 3年前开始多饮，多食，多尿
D. 吞咽困难，进行性加重已1月余
E. 某医院确诊为肺癌，介绍病人来诊

正确答案：D。吞咽困难，进行性加重已1月余

解析：主诉一般包括就诊主要症状（或体征）及持续时间，要简明精炼，一般在1～2句，20字左右。患高血压病3年（A错）、心绞痛反复发作3年（B错）中出现了明确的诊断，而主诉中只能出现促使该患者就诊的主要症状或体征。3年前开始多饮，多食，多尿（C错）中症状和时间的顺序错误。某医院确诊为肺癌，介绍病人来诊（E错）中的信息与促使患者就诊的主要症状或体征无关。吞咽困难，进行性加重已1月余（D对）符合正确的书写要求。